女，35岁，血常规检查发现三系细胞减少1月余，发热3天。查体：T38.5℃肝脾肋下未触及。骨髓细胞学检查：增生极度低下，可见较多脂肪滴。首先考虑的诊断是
A. 淋巴瘤
B. 骨髓增生异常综合征
C. 急性白血病
D. 阵发性睡眠性血红蛋白尿
E. 再生障碍性贫血

正确答案：E。再生障碍性贫血

解析：患者血常规检查发现三系细胞减少1月余（再生障碍性贫血血象最典型特征），发热3天（白细胞减少，易发生感染），骨髓细胞学检查发现增生极度低下，可见较多脂肪滴（再生障碍性贫血骨髓象典型特征），综合该患者症状和实验室检查，该患者诊断考虑为再生障碍性贫血（E对）。淋巴瘤（A错）常有淋巴结肿大的临床表现，血象淋巴细胞数增多，部分病人骨髓涂片可找到淋巴瘤细胞。骨髓增生异常综合征（B错）血象持续一系或多系血细胞减少：血红蛋白＜100g/L、中性粒细胞＜1.8×10⁹/L、血小板＜100×10⁹/L；而骨髓增生度多在活跃以上。急性白血病（C错）血象大多数病人白细胞增多，常＞10×10⁹/L，多数 AL骨髓象有核细胞显著增生，以原始细胞为主。阵发性睡眠性血红蛋白尿（D错）有晨起血红蛋白尿的临床表现，约半数病人全血细胞减少，而骨髓增生活跃。